外源性化学物质吸收途径主要是
A. 胃肠道
B. 呼吸道
C. 皮肤
D. 血液循环
E. 胃肠道、呼吸道、皮肤

正确答案：E。胃肠道、呼吸道、皮肤